肘关节脱位的特有体征
A. 患肘肿痛、不能活动
B. 以健侧手托患侧前臂
C. 肘后三角关系正常
D. 肘后三角关系异常
E. 肘关节处于半伸直位

正确答案：D。肘后三角关系异常

解析：肘关节由肱骨下端、尺骨鹰嘴窝、桡骨头及关节囊、韧带构成。肘关节屈曲呈直角时，肱骨内外上髁和尺骨鹰嘴3点构成等腰三角形，称肘后三角。肘关节脱位多由于关节囊撕裂，尺骨鹰嘴向肱骨前后方脱出使得肘后正常三角关系改变（D对C错）。患肘肿痛不能活动（A错）、以健侧手托患侧手臂（B错）为骨折、关节脱位时的一般表现，不是肘关节脱位的特有体征。肘关节脱位时肘关节处于半屈位（E错）。